关于复发性口腔溃疡特征描述正确的是
A. 具有特异性、复发性和自限性
B. 具有传染性、周期性和自限性
C. 具有特异性、传染性和复发性
D. 具有周期性、复发性和自限性
E. 具有聚集性、特异性和周期性

正确答案：D。具有周期性、复发性和自限性

解析：本题考查复发性阿弗他溃疡。关于复发性口腔溃疡特征描述正确的是具有周期性、复发性和自限性（D对）。复发性阿弗他溃疡（RAU）又称复发性阿弗他口炎、复发性口腔溃疡，具有周期性、复发性、自限性特征，溃疡灼痛明显。一般表现为反复发作的圆形或椭圆形溃疡，具有“黄、红、凹、痛”的临床特征，即溃疡表面覆盖黄色假膜、周围有红晕带、中央凹陷、疼痛明显。溃疡的发作周期长短不一，可分为发作期（前驱期-溃疡期）、愈合期、间歇期，且具有不治自愈的自限性。